在浓度相同的条件下，下列石棉纤维的危害性最大的是
A. 直径2.9μm，长度9μm
B. 直径3.9μm，长度12μm
C. 直径4.9μm，长度15μm
D. 直径5.9μm，长度18μm
E. 直径6.9μm，长度21μm

正确答案：A。直径2.9μm，长度9μm